根据《中华人民共和国药品管理法实施条例》，应当定期发布药品质量公告的是
A. 国务院药品监督管理部门
B. 省、自治区、直辖市人民政府的药品监督管理部门
C. 国务院和省、自治区、直辖市人民政府的药品监督管理部门
D. 设区的市级药品监督管理机构
E. 省级人民政府药品监督管理部门依法设立的药品检验机构

正确答案：C。国务院和省、自治区、直辖市人民政府的药品监督管理部门

解析：本题考查的是药品质量公告的定义。根据《中华人民共和国药品管理法实施条例》，应当定期发布药品质量公告的是国务院和省、自治区、直辖市人民政府的药品监督管理部门（C对）。药品质量公告的定义：药品质量公告是指由国务院和省级药品监督管理部门向公众发布的有关药品质量抽查检验结果的通告。《药品管理法》第101条规定，国务院和省、自治区、直辖市人民政府的药品监督管理部门应当定期公告药品质量抽查检验的结果；公告不当的，应当在原公告范围内予以更正。药品质量公告是药品监督管理的一项重要内容，也是药品监督管理部门的法定义务，药品抽查检验的结果应当依法向社会公告。